血清抗体滴度资料最常以
A. 算术均数
B. 中位数
C. 几何均数
D. 标准差
E. 百分位数

正确答案：C。几何均数

解析：几何均数：几何均数用G表示，适用于某些呈非正态分布，但数据经过对数变换后呈正态分布的资料，也可用于观察值之间呈倍数或近似倍数变化（等比关系）的资料，